男，10岁。发热、头痛、呕吐3天，嗜睡半天，于7月10日入院。既往体健。查体：T38.6℃，P112次/分，R20次/分，BP130/75mmHg。神志不清，皮肤未见出血点，心肺未见异常，腹软，压痛及反跳痛（-），肝脾肋下未触及，颈抵抗（+），双侧Babinski征（+）。实验室检查：血WBC12.4×10⁹/L，中性粒细胞0.70，淋巴细胞0.30。腰穿脑脊液检查：压力200mmH2O，WBC170×10⁶/L，单核0.66，多核0.34，蛋白1.1g/L，糖4.2mmol/L，氯化物115mmol/L。该患者最可能的诊断是
A. 流行性乙型脑炎
B. 肾综合征出血热
C. 流行性脑脊髓膜炎
D. 结核性脑膜炎
E. 隐球菌性脑膜炎

正确答案：A。流行性乙型脑炎

解析：男性儿童 ，发热头痛呕吐3天，嗜睡半天（流行性乙型脑炎初期症状），于7月10日入院（流行性乙型脑炎夏秋季高发），既往体健，查体T38.6℃（正常值36～37℃），P112次/分（正常值60～100次/分），R20次/分（正常值12～20次/分），BP130/75mmHg（正常值小于120/80mmHg）。神志不清，皮肤未见出血点，心肺未见异常，腹软，压痛及反跳痛（－），肝脾肋下未触及，颈抵抗（+），双侧Babinski征（+）（流行性乙型脑炎极期症状）。实验室检查血WBC124×10⁹/L（正常值4～10×10⁹/L），中性粒细胞0.70（正常值0.5～0.75），淋巴细胞0.30（正常值0.2～0.4）。腰穿脑脊液检查压力200mmH₂O（儿童脑压正常值40～100mmH₂O），WBC170×10⁶/L（儿童正常值0～15×10⁶/L），单核0.66（正常值0.3），多核0.34，蛋白11g/L（腰穿正常值0.2～0.45g/L），糖4.2mmol/L（腰穿正常值2.5～4.5mmol/L），氯化物115mmol/L（腰穿正常值120～130mmol/L），结合患者病史、临床表现及实验室检查，应诊断为流行性乙型脑炎（A对）。临床上以高热、意识障碍、抽搐、病理反射及脑膜刺激征为特征，外周血白细胞总数增高，脑脊液压力增高，白细胞增多，蛋白轻度增高，糖正常或偏高，氯化物正常。肾综合症出血热（B错），又称流行性出血热，是由汉坦病毒病毒引起的，以鼠类为主要传染源的一种自然疫源性疾病，本病的主要病理变化是全身小血管和毛细血管广泛性损害，临床上以发热、低血压休克、充血出血和肾损害为主要表现，可有典型“三痛征”和“三红征”（P77）。流行性脑脊髓膜炎（C错）的病原菌是脑膜炎奈瑟菌，儿童易感，前驱期主要表现为上呼吸道症状，败血症期可见高热寒战，伴有明显的全身中毒症状，精神极度萎靡，可见皮肤瘀斑瘀点（P207）。结核性脑膜炎（D错）起病缓慢，多于1～2周非特异性感染症状后，出现脑膜刺激征。隐球菌性脑膜炎（E错）病初症状不明显，常有间歇性头痛、发热，随着颅内压的进一步增加，头痛剧烈，可伴有恶心、呕吐、烦躁和性格改变等表现，体检可发现步态蹒跚、颈项强直、脑膜刺激征阳性，但血常规一般正常、脑脊液压力可达600mmH₂O，脑脊液、血液科分离到隐球菌是诊断最好的依据（P234）。